确认的致癌物的判定依据来自
A. 临床观察
B. 实验研究
C. 流行病学调查
D. 动物实验
E. 体外试验

正确答案：C。流行病学调查

解析：本题考查确认致癌物的判定依据。流行病学调查（C对ABDE错）的研究对象是人群，对于识别和判定某种因素对人类的致癌性可提供最强有力的证据。职业肿瘤流行病学是研究职业性肿瘤流行规律的学科，探索职业性肿瘤的人群分布及其与致癌因素间的关系，从群体角度寻找肿瘤发生的原因和规律。识别和判认职业性致癌因索，仅靠临床观察和实验研究尚显不足，必须通过流行病学调查在人群中取得确切的证据。